触膜足背动脉搏动的位置在
A. 胫骨前肌腱外侧
B. 长伸肌腱内侧
C. 长伸肌腱外侧
D. 趾长伸肌腱外侧
E. 无

正确答案：C。长伸肌腱外侧

解析：踇长伸肌腱外侧（C对），踝关节的前方，内、外踝前方连线的中点为触膜足背动脉搏动的位置，足背出血时可在该处压迫足背动脉进行止血。